在全部人群中开展戒烟运动预防肺癌属于
A. 一级预防
B. 二级预防
C. 三级预防
D. 个体治疗
E. 社区综合防治

正确答案：A。一级预防